创可贴的包装上应有
A. 无菌字样
B. 氧化锌量说明
C. 一次性使用说明
D. 包装破损严禁使用
E. C.C.C.认证和证明标记

正确答案：A、C、D。无菌字样；一次性使用说明；包装破损严禁使用

解析：本题考查的是创可贴的包装。创可贴的包装上应有无菌字样（A对）、一次性使用说明（C对）、包装破损严禁使用（D对）。